下列不属谵妄表现的是
A. 意识大部分丧失
B. 谵语
C. 躁动不安
D. 意识模糊
E. 错觉

正确答案：A。意识大部分丧失

解析：谵妄是一种以兴奋性增高为主的高级神经中枢急性活动失调状态，是在意识模糊（D对）的同时表现有定向力障碍及自身认识障碍，并产生大量的幻觉、错觉（E对）、躁动不安（C对）、谵语（即言语杂乱）（B对）等。意识大部分丧失（A错，为本题正确答案）为昏迷的表现。